下列适用于水飞法粉碎的药物有
A. 珍珠
B. 炉甘石
C. 芒硝
D. 朱砂
E. 乳香

正确答案：A、B、D。珍珠；炉甘石；朱砂